“通因通用”适用于治疗的病证是
A. 实证
B. 虚证
C. 虚实错杂证
D. 真虚假实证
E. 真实假虚证

正确答案：E。真实假虚证

解析：适用于实证的是实则泻之（A错）。适用于虚证的是虚则补之（B错）。适用于虚实错杂证的是攻补兼施或扶正与祛邪先后运用（C错）。适用于真虚假实证的是塞因塞用（D错）。通因通用即是用具有泻下通利功用的方药治疗具有通泻下利症状的实证，适用于真实假虚证（E对）。